下列除哪项外，均是小儿暑温的预防、护理措施
A. 进行乙脑疫苗预防接种
B. 做好灭蝇、灭蛆工作
C. 发现病人及早隔离
D. 病室保持通风凉爽
E. 昏迷患儿经常翻身

正确答案：C。发现病人及早隔离

解析：小儿暑温相当于现代医学的流行性乙型脑炎，为人畜共患疾病，五版教材未提及隔离，七版教材则提出应及早治疗，早期隔离。此题年份为五版教材使用期间，故（C对）。流行性乙型脑炎是由乙脑病毒引起的自然疫源性疾病，应进行乙脑疫苗的接种使机体产生免疫力（A错）。乙脑经蚊媒传播，所以要做好灭蝇、灭蛆工作（B错）。病室保持通风凉爽使空气流通，利于病人的恢复（D错）。经常翻身以防止褥疮（E错）。